女，25岁。初产妇，妊娠40周，阵发性下腹痛6小时，自然破膜5小时，羊水清，胎心110次/分，宫口开大2cm，头先露，产时胎心监护显示多次晚期减速，此时最佳当的处理是
A. 静滴缩宫素
B. 立即行剖宫产术
C. 吸氧并继续观察产程
D. 宫颈注射地西泮
E. 静滴硫酸镁

正确答案：B。立即行剖宫产术

解析：初产妇患者，妊娠40周，产时胎心监护显示多次晚期减速（提示胎儿严重缺氧），此时宫口开大2cm，提示短时间内无法经阴道分娩，此时，可根据胎头位置决定治疗措施：若胎头下降至≥+3水平，可行产钳或胎头吸引器助产术；胎头位置在≤+2水平以上，应及时行剖宫产术（B对）。宫颈注射地西泮（D错）、静滴硫酸镁（E错）均为抑制宫缩。静滴缩宫素（A错）可加强产力，促进产程进展，主要用于第一产程延长等情况。